判断受教育程度对人们健康影响的两个重要指标是
A. 学历和社会职位
B. 社会职位与事业成就
C. 消费结构和闲暇时间如何安排
D. 事业成就与消费水平
E. 消费水平和消费方式

正确答案：C。消费结构和闲暇时间如何安排

解析：本题考查判断受教育程度对人们健康影响的重要指标。判断受教育程度对人们健康影响的两个重要指标是消费结构和闲暇时间如何安排（C对ABDE错）。